下列属于药品类易制毒药品的是
A. 可待因
B. 麦角胺
C. 伪麻黄碱
D. 氯胺酮

正确答案：B、C。麦角胺；伪麻黄碱

解析：本题考查药品类易制毒化学品的品种与分类。属于药品类易制毒化学品的有麦角胺（B对）、伪麻黄碱（C对）。目前，药品类易制毒化学品分为两类，即：麦角酸和麻黄素等物质。药品类易制毒化学品品种目录（2010版）所列物质有：（1）麦角酸；（2）麦角胺；（3）麦角新碱；（4）麻黄素、伪麻黄素、消旋麻黄素、去甲麻黄素、甲基麻黄素、麻黄浸膏、麻黄浸膏粉等麻黄素类物质。（麻黄素也称为麻黄碱）。麻醉药品目录：可卡因、罂粟浓缩物（包括罂粟果提取物、罂粟果提取物粉）、吗啡、阿片、可待因（A错）等。精神药品目录：司可巴比妥、氯胺酮（D错）、马吲哚、三唑仑等。